下列属于营养必需脂肪酸的是
A. 软脂酸
B. 亚麻酸
C. 硬脂酸
D. 油酸
E. 十二碳脂肪酸

正确答案：B。亚麻酸